以下哪项符合检验科和病理科人员的道德要求
A. 要有严谨的科学作风
B. 要有实事求是的态度
C. 不能徐改、谎报结果
D. 要有急患者所急的态度
E. 以上都对

正确答案：E。以上都对